立克次体的繁殖方式是
A. 二分裂繁殖
B. 出芽繁殖
C. 分节繁殖
D. 断裂繁殖
E. 分枝繁殖

正确答案：A。二分裂繁殖